女性，54岁，右下876左下34缺失，右下5设计RPI卡环时，导平面应预备在右下5的
A. 近中边缘嵴
B. 远中边缘嵴
C. 远中颊轴角
D. 远中舌轴角
E. 远中邻面

正确答案：E。远中邻面

解析：本题考查局部义齿固位体。RPI卡环由近中（牙合）支托、邻面板和I型杆卡环臂三部分组成。邻面板位于游离缺失末端基牙的远中邻面（E对），基牙与邻面板接触的部位需要预备导平面，与邻面板密合，与就位道方向一致。